食管的第三个狭窄距中切牙
A. 15cm
B. 25cm
C. 40cm
D. 50cm
E. 75cm

正确答案：C。40cm

解析：食管的第三个狭窄距中切牙约40cm(C对)，第一个狭窄距中切牙约15cm(A错)，第二个狭窄距中切牙约25cm(B错)。